某女，30岁。平素急躁易怒，近半年又见大便秘结。宜选用的药是
A. 芦荟
B. 芒硝
C. 龙胆
D. 火麻仁
E. 番泻叶

正确答案：A。芦荟

解析：本题考查的是芦荟的主治病证。平素急躁易怒，近半年又见大便秘结。宜选用的药是芦荟（A对）。芦荟：【主治病证】（1）热结便秘，肝经实火，肝热惊风。（2）小儿疳积，虫积腹痛。（3）癣疮（外用）。芒硝（B错）：【主治病证】（1）实热积滞，大便燥结。（2）咽喉肿痛，口舌生疮，目赤肿痛，疮疡，乳痈，肠痈，痔疮肿痛。龙胆（C错）：【主治病证】（1）湿热下注之阴肿阴痒、带下、阴囊湿疹，湿热黄疸。（2）肝火上炎之头痛目赤、耳聋胁痛等。（3）高热抽搐，小儿急惊，带状疱疹。火麻仁（D错）：【主治病证】老人、产妇及体虚之津枯肠燥便秘。番泻叶（E错）：【主治病证】（1）热结便秘。（2）食积胀满。（3）水肿胀满。